下列各项，除哪项外，均属消渴的常见变证
A. 肺痨
B. 吐血
C. 中风
D. 痈疽
E. 水肿

正确答案：B。吐血

解析：消渴病容易并发多种病证，应在治疗本病的同时，积极治疗并发症。如肾阴亏损，肝失濡养，肝肾精血不能上承于耳目，则可并发白内障、雀目、耳聋；燥热内结，营阴被灼，脉络瘀阻，蕴毒成脓，则发为疮毒痈疽；肺失滋养，日久可并发肺痨；阴虚燥热，炼液成痰，以及血脉瘀滞，痰瘀阻络，蒙蔽心窍，则发为中风偏瘫；阴损及阳，脾肾衰败，水湿潴留，泛滥肌肤，则发为水肿，可见除吐血外，其他选项均是消渴的常见变证（B对）。(ACDE错）。